免疫球蛋白的基本结构是
A. Ig单体由两条相同的重链和两条相同的轻链由链间二硫键连接组成
B. Ig多体由两条相同的重链和两条相同的轻链由链间二硫键连接组成
C. Ig单体由两条相同的重链和两条相同的轻链由链间三硫键连接组成
D. Ig多体由两条相同的重链和两条相同的轻链由链间三硫键连接组成
E. Ig单体由两条不同的重链和两条相同的轻链由链间二硫键连接组成

正确答案：A。Ig单体由两条相同的重链和两条相同的轻链由链间二硫键连接组成

解析：免疫球蛋白的基本结构：Ig单体由两条相同的重链和两条相同的轻链由链间二硫键连接组成。掌握“免疫球蛋白基本概念及结构”知识点。